骨折愈合的第二期是
A. 原始骨痂形成期
B. 血肿机化演进期
C. 骨痂改造塑形期
D. 膜内化骨吸收期
E. 软骨内化骨吸收期

正确答案：A。原始骨痂形成期

解析：骨折愈合是一个复杂而连续的过程过程，通常将其分为三个阶段：血肿炎症机化期→原始骨痂形成期→骨痂改造塑形期。可见第二期为原始骨痂形成期（A对）。血肿机化演进期即血肿炎症机化期，是骨折愈合的第一期（B错）。骨痂改造塑形期是骨折愈合的第三期（C错）。而膜内化骨吸收期（D错）与软骨内化骨吸收期（E错）均属于骨痂改造塑形期。